上述各项中属于医生违背不伤害原则的是
A. 医生检查病人时，由于消毒观念不强，造成交叉感染
B. 医生满足病人的一切保密要求
C. 妊娠危及母亲的生命时，医生给予引产
D. 医生对病人的呼叫或提问给予应答
E. 医生的行为使某个病人受益，但却损害了别的病人的利益

正确答案：A。医生检查病人时，由于消毒观念不强，造成交叉感染

解析：不伤害原则是指在医务人员的整个医疗行为中，无论动机，还是效果，均应避免对病人造成伤害。医生检查病人时，由于消毒观念不强，造成了交叉感染（A对），对病人造成了伤害，违背了不伤害原则。妊娠危及母亲的生命时，医生给予引产（C错）；医生对病人的呼叫或提问给予应答（D错）属于遵守不伤害原则。医生的行为使某个病人收益，但却给别的病人带来了损害（E错），属于违背有利原则。尊重原则的合理性源于病人享有人格尊严和医疗自主权，但其实现取决于医务人员对其合理性的认同以及医患之间平等关系的认可和构建，医生尊重病人不是指满足病人的一切要求（B错）。